某药物在三氯醋酸存在下水解、脱羧，生成戊糖，再失水，转变为糠醛，加入吡咯，加热至50℃产生蓝色。该药物是
A. 维生素A
B. 维生素B₁
C. 维生素E
D. 维生素C
E. 青霉素钾

正确答案：D。维生素C